（牙合）翼片常用于检查
A. 牙周病变
B. 邻面龋变
C. 根尖病变
D. 上下牙咬合关系

正确答案：B。邻面龋变

解析：本题考查（牙合）翼片的正常图像。（牙合）翼片常用于检查上下牙冠部病变，可用来检查邻面龋变（B对）。（牙合）翼片主要显示上下牙的牙冠部。常用于检查邻面龋、髓石、牙髓腔的大小、邻面龋与髓室是否穿通和穿通程度，以及充填物边缘密合情况等，主要用于前磨牙和磨牙区检查。此外尚可清晰地显示牙槽嵴顶，可用于确定是否有牙槽嵴顶的破坏性改变。在儿童尚可用于观察滞留乳牙根的部位及位置、恒牙胚的部位及其与乳牙根的关系以及乳牙根的吸收类型等。牙周病变（A错）用曲面体层摄影片检查。根尖病变（C对）用根尖片检查。上下牙咬合关系（D错）用X线头影测量片检查。